以下关于牙齿磨损的描述，正确的是
A. 生理性磨损是机械摩擦作用而造成的牙体硬组织慢性损耗
B. 咀嚼磨损会导致牙体硬组织的严重丧失
C. 均匀适宜的损耗对牙周组织的健康有重要意义
D. 非咀嚼磨损，会引起牙齿病理性改变
E. 磨损均可引起牙本质过敏

正确答案：D。非咀嚼磨损，会引起牙齿病理性改变

解析：磨损指牙齿表面与外物机械摩擦而产生的牙体组织损耗，如刷牙引起牙冠唇、颊面或颈部等处的非生理性损耗。掌握“牙动度和唇、舌、腭对咀嚼的作用”知识点。